适用于高血压合并心绞痛患者的药物是
A. 缬沙坦
B. 美托洛尔
C. 非洛地平
D. 氢氯噻嗪
E. 赖诺普利

正确答案：B。美托洛尔

解析：本题考查各类高血压药物的选用。适用于高血压合并心绞痛患者的药物是美托洛尔（B对）。β受体阻断药：如美托洛尔，适用于一、二级高血压，尤其适用于静息时心率较快的中青年患者合并心绞痛者。心脏传导阻滞、哮喘、慢性阻塞性肺病与周围血管病患者禁用。2型糖尿病患者慎用。血管紧张素Ⅱ受体阻断药：如缬沙坦（A错），适用于轻中度原发性高血压，尤其适用肾脏损害所致继发性高血压。钙通道阻滞剂：如非洛地平（C错），一般与其他抗压药物联用，适用于老年高血压、单纯收缩压高血压、伴稳定性心绞痛、冠状动脉或颈动脉粥样硬化及周围血管病患者。利尿剂：如氢氯噻嗪（D错），适用于一、二级高血压，尤其是老年高血压或并发心力衰竭者，但痛风患者禁用，糖尿病和高脂血症患者慎用。血管紧张素转换酶抑制剂(ACEI)：如赖诺普利（E错），适用于高血压合并糖尿病，或者并发左心功能不全、肾损害有蛋白尿的患者。妊娠和肾动脉狭窄者禁用。